消化性溃疡患者发生夜间痛和背部痛最突出的是
A. 十二指肠球后壁溃疡
B. 幽门管溃疡
C. 胃小弯溃疡
D. 胃大弯溃疡
E. 胃后壁溃疡

正确答案：A。十二指肠球后壁溃疡